男，76岁。无排便7天，腹痛、呕吐2天。平素便秘。查体：肠鸣音亢进。最有可能的诊断是
A. 急性胃炎
B. 急性腹膜炎
C. 急性阑尾炎
D. 急性胰腺炎
E. 急性肠梗阻

正确答案：E。急性肠梗阻

解析：老年男性患者，腹痛、呕吐2天，无排便7天（肠梗阻常见症状）；查体肠鸣音亢进（肠梗阻早期常见体征），结合上述临床表现，最可能的诊断为急性肠梗阻（E对）。急性胃炎（A错）、急性腹膜炎（B错）、急性阑尾炎（C错）、急性胰腺炎（D错）可出现腹痛、呕吐等表现，但可排便，肠鸣音一般减弱。